胃大部切除术后数月或数年多发生的合并症为
A. 腹泻
B. 碱性返流性胃炎
C. 出血
D. 呕吐
E. 吻合口溃疡

正确答案：B。碱性返流性胃炎

解析：胃十二指溃疡行胃大部切除术后，由于术中操作不当或解剖、生理的改变可出现多种并发症，按出现的时间顺序可分为早期并发症和远期并发症。晚期并发症包括倾倒综合征、碱性反流性胃炎、溃疡复发、残胃癌等，其中碱性反流性胃炎常于术后数月至数年发生（七版外科学P436）（B对）。复发性溃疡以吻合口或吻合口附近空肠黏膜的复发性溃疡最为多见，称为吻合口溃疡，多发生于术后2～3年（E错）。腹泻（A错）不是胃大部切除术后的合并症。出血（C错）、术后胃瘫、十二指肠残端破裂、术后肠梗阻等为早期并发症。合并术后肠梗阻时可有上腹不适、呕吐等表现（D错）。